长期应用可引起血钾升高和男性乳房发育的药物是
A. 布美他尼
B. 呋塞米
C. 依他尼酸
D. 托拉塞米
E. 螺内酯

正确答案：E。螺内酯

解析：本题考查螺内酯的不良反应。长期应用可引起血钾升高和男性乳房发育的药物是螺内酯（E对）。螺内酯用于水肿性疾病、高血压、原发性醛固酮增多症、低钾血症的预防，长期应用可引起血钾升高和男性乳房发育等。布美他尼（A错）长期应用可引起体位性低血压、体克、低钾血症、低氯血症、低氯性碱中毒、低钠血症、低钙血症等。呋塞米（B错）长期应用可引起体位性低血压、休克、低钾血症、低氯血症、低氯性碱中毒、低钠血症、低钙血症以及与此有关的口渴、乏力、肌肉酸痛、心律失常等。依他尼酸（C错）长期应用可引起体位性低血压、休克、低钾血症、低氯血症、低氯性碱中毒、低钠血症、低钙血症以及与此有关的口渴、乏力、肌肉酸痛、心律失常等。托拉塞米（D错）停药的最常见原因依次为头晕、头痛、恶心、虚弱、呕吐、高血糖、排尿过多、高尿酸血症、低钾血症、极度口渴、血容量不足、阳萎、食道出血等。